已婚中年男性，龟头部有乳头状赘生物，醋酸白试验阳性，提示
A. 人乳头瘤病毒
B. 梅毒螺旋体
C. 苍白螺旋体
D. 淋球菌
E. 人类免疫缺陷病毒

正确答案：A。人乳头瘤病毒

解析：人类乳头瘤病毒感染的上皮细胞与正常细胞产生的角蛋白不同，能被冰醋酸致白，故可用醋酸白试验来辅助检查是否HPV感染（A对）。